患者女性23岁。左上第三磨牙近中阻生需要拔除。在行左侧上牙槽后神经口内阻滞麻醉后不久出现血肿，最可能的原因是
A. 发生了肾上腺素反应
B. 刺入位置过后，刺伤翼静脉丛
C. 患者过度紧张
D. 麻药注入腮腺内麻醉了面神经
E. 麻药注入翼内肌

正确答案：B。刺入位置过后，刺伤翼静脉丛

解析：本题考查局部麻醉的并发症。行左侧上牙槽后神经口内阻滞麻醉后不久出现血肿，最可能的原因是刺入位置过后，刺伤翼静脉丛（B对）。局麻导致的血肿，一般可自行吸收消失。发生了肾上腺素反应（A错）：主要表现为头痛等症状。患者过度紧张（C错）：一般不引起组织血肿。麻药注入腮腺内麻醉了面神经（D错）：常表现为暂时性面瘫，通常持续1小时即可恢复。麻药注入翼内肌（E错）：常表现为牙关紧闭，大多在2～3小时内自行恢复。